疾病每年在一定的季节内发病率升高的现象
A. 季节性
B. 周期性
C. 短期波动
D. 遗传性
E. 长期变异

正确答案：A。季节性

解析：季节性：即疾病每年在一定的季节内出现发病率升高的现象。掌握“流行病学资料与疾病分布”知识点。